葡萄糖重吸收的部位主要在
A. 近球小管
B. 髓袢细段
C. 远曲小管和集合管
D. 髓袢降支粗段
E. 髓袢升支粗段

正确答案：A。近球小管